下列除哪项外，均为十五络脉的分布特点
A. 十二经的别络走向相表里的经脉
B. 十二经的别络从本经四肢肘膝关节以下的络穴分出
C. 向心性循环
D. 任脉别络从鸠尾分出后散布于腹部
E. 督脉别络从长强分出后散布于头

正确答案：C。向心性循环

解析：十二经脉的别络均从本经四肢肘膝关节以下的络穴分出（B对），走向其相表里的经脉（A对），即阴经别络走向阳经，阳经别络走向阴经。任脉、督脉的别络以及脾之大络主要分布在头身部。任脉的别络从鸠尾分出后散布于腹部（D对）；督脉的别络从长强分出后散布于头（E对），左右别走足太阳经；脾之大络从大包分出后散布于胸胁。此外，还有从络脉分出的浮行于浅表部位的浮络和细小的孙络，分布极广，遍布全身。四肢部的十二经别络，加强了十二经中表里两经的联系，沟通了表里两经的经气，补充了十二经脉循行的不足。躯干部的任脉别络、督脉别络和脾之大络，分别沟通了腹、背和全身经气。向心性是十二经别的功能，加强了体表与体内、四肢与躯干的向心性联系。十五络脉的分布特点不具有向心性循环（C错，为本题正确答案）。